某患者在医院就诊时，检查结果显示该患者为痰涂片阳性肺结核患者。以下说法正确的是
A. 该患者不会传播结核病
B. 应对该患者立即接种卡介苗
C. 此类患者是结核病病例发现的主要目标
D. 对该患者应进行药物预防
E. 给予短程抗结核药物治疗

正确答案：C。此类患者是结核病病例发现的主要目标